与舌共同压挤食物外，能辨别食物粗糙的程度
A. 舌在咀嚼中的作用
B. 唇在咀嚼中的作用
C. 颊在咀嚼中的作用
D. 腭在咀嚼中的作用
E. 咽在咀嚼中的作用

正确答案：D。腭在咀嚼中的作用

解析：腭在咀嚼中的作用，除与舌共同压挤食物外，硬腭的触觉甚为敏感，能辨别食物粗糙的程度。掌握“牙动度和唇、舌、腭对咀嚼的作用”知识点。